肠外营养的技术性并发症中最严重的是
A. 神经损伤
B. 空气栓塞
C. 胸导管损伤
D. 气胸
E. 血胸

正确答案：B。空气栓塞

解析：肠外营养的技术性并发症是指中心静脉置管、输液等技术问题所致的并发症，是在中心静脉导管防止过程中发生气胸、空气栓塞、血管、神经损伤等，也有少数是在长期应用、导管护理不当或拔管操作所致，如导管脱出、导管这段、导管堵塞等，其中最严重的是空气栓塞，若大量气体（多于100ml) 迅速进入静脉，随血流到右心后，因心脏搏动，将空气与血液搅拌形成大量血气泡，充满心腔，阻碍静脉血的回流和向肺动脉的输出，造成严重的循环障碍，患者可出现呼吸困难，发绀，甚至猝死。进入右心的部分气泡，可进入肺动脉阻塞小的肺动脉分支，引起肺小动脉气体栓塞。